凝胶剂常用的基质是
A. 卡波姆
B. 乙醇
C. 丙二醇
D. 羟苯乙酯
E. 聚山梨酯

正确答案：A。卡波姆

解析：本题考查凝胶剂的基质。凝胶剂常用的基质包括卡波姆（A对）、纤维素衍生物。